胰岛素对糖代谢的影响主要是
A. 抑制葡萄糖的运转，减少组织的摄取
B. 抑制葡萄糖的氧化分解
C. 增加糖原的合成和贮存
D. 促进糖原分解和异生
E. 抑制葡萄糖排泄

正确答案：C。增加糖原的合成和贮存

解析：本题考查胰岛素对糖代谢的影响。胰岛素对糖代谢的影响主要是增加糖原的合成和贮存（C对）。胰岛素作用机制为增加葡萄糖的利用，加速葡萄糖的无氧酵解和有氧氧化，促进肝糖原和肌糖原的合成和贮存，使血糖降低。